患者，女，54岁，诊断为类风湿关节炎2年，目前服用甲氨蝶呤（15mgqw）和塞来昔布（200mgqd）。患者因担心药品不良反应，用药不规律，时断时续，近日出现关节肿胀和疼痛加重，晨僵明显，加用泼尼松10mgqd。关于该患者用药注意事项的说法，错误的是
A. 应定期监测肝功能
B. 泼尼松应于清晨服用
C. 应定期监测血糖、血压
D. 应定期监测骨密度
E. 甲氨蝶呤应隔日一次用药

正确答案：E。甲氨蝶呤应隔日一次用药

解析：本题考查患者用药教育。关于该患者用药注意事项的说法，错误的是甲氨蝶呤应隔日一次用药（E错，为本题正确答案）。甲氨蝶呤口服、肌注或静注均有效，多采用每周1次给药，常用剂量为7.5～25mg/w。常见不良反应有恶心、口炎、腹泻、脱发、皮疹，少数出现骨髓抑制、听力损害、肺间质病变，也可引起流产、畸胎和影响生育能力。服药期间，应适当补充叶酸，定期监测血常规和肝功能（A对）。激素治疗RA的原则是尽可能小剂量、短期使用；并治疗过程中注意补充钙剂和维生素D以防止骨质疏松（D对），还应监测血压和血糖变化（C对）。糖皮质激素的分泌节律呈昼夜节律性变化，血药浓度峰值一般在清晨7～8时，谷值则在午夜0时。清晨给药可以减少对下丘脑-垂体-肾上腺皮质系统的反馈抑制而避免导致肾上腺皮质功能下降（B对）。